颅囟
A. 有四对
B. 出生后不久闭合
C. 由软骨化骨形成
D. 后囟最大
E. 前囟的闭合时间最晚

正确答案：E。前囟的闭合时间最晚

解析：前囟在生后 1 -2 岁时闭合，其余各囟均于生后不久闭合（E对B错）。颅囟是颅顶各骨尚未完全发育，骨缝间充满纤维组织膜，在多骨交接处，间隙的膜较大形成的（C错）。前囟（额囟）最大（D错）。颅囟共4个（A错）。